既涌吐痰饮，又截疟的药是
A. 柴胡
B. 青蒿
C. 常山
D. 砒石
E. 生首乌

正确答案：C。常山